化脓性阑尾炎行阑尾切除术，术后3天切口红肿，有脓性分泌物，10天后再次缝合而愈合，切口愈合类型应记为
A. Ⅱ/乙
B. Ⅱ/丙
C. Ⅲ/甲
D. Ⅲ/乙
E. Ⅲ/丙

正确答案：E。Ⅲ/丙